乳牙龋病充填治疗中不能用的垫底材料是
A. 聚羧酸锌黏固粉
B. 磷酸锌水门汀
C. 玻璃离子水门汀
D. 丁香油黏固粉
E. 硬性氢氧化钙

正确答案：B。磷酸锌水门汀

解析：本题考查窝洞垫底。乳牙龋病充填治疗中不能用的垫底材料是磷酸锌水门汀（B错，为本题的正确答案）。乳牙的牙釉质和牙本质薄，即使已近牙髓的窝洞也不如恒牙深。乳牙所承受的咀嚼压力虽不如恒牙大，但乳牙窝洞的部位不同、深度不一，所选用的垫底材料也有所区别，主要从材料的抗压力和对牙髓的刺激性加以综合考虑。例如在邻面的单面窝洞，可在轴髓壁选用硬质氢氧化钙制剂（E对）或氧化锌丁香油酚水门汀（D对）垫底；若在乳磨牙（牙合）面的窝洞，因所受的咀嚼压力较大，可用玻璃离子水门汀（C对）或聚羧酸锌水门汀（A对）垫底；在深的近髓的窝洞，应注意一定用硬质氢氧化钙制剂先行护髓，再加所选择的水门汀垫底。由于磷酸锌水门汀对牙髓刺激性大，不适合作为活髓牙的垫底材料。